下列哪个不是常用于评价儿童健康状况的指标
A. 检出率
B. 发病率
C. 患病率
D. 因病缺课率
E. 平均因病缺课日数

正确答案：C。患病率